拟对某中药进行亚慢性毒性试验，其高剂量组的剂量至少应等于人拟用最高剂量的
A. 10倍
B. 30倍
C. 50倍
D. 100倍
E. 300倍

正确答案：C。50倍